由于对花粉等过敏产生哮喘，血清IgE增高可能是
A. 内源性哮喘
B. 外源性哮喘
C. 肺气肿
D. 肺炎球菌肺炎
E. 混合型哮喘

正确答案：B。外源性哮喘

解析：花粉对人体来说是异物，可引起人体过敏反应，并产生哮喘，血中IgE升高，此种哮喘称为外源性哮喘（B对AE错）（是患者对致敏原产生过敏的反应，致敏原包括尘埃、花粉、动物毛发、衣物纤维等等）。肺气肿（C错）多见于老年人，没有明确的过敏反应，表现为长期的咳痰喘。肺炎球菌肺炎（D错）表现为高热，咳嗽，为感染肺炎链球菌所致。